属于个人史的是
A. 月经情况
B. 生育情况
C. 冶游史
D. 家族遗传病史
E. 预防接种史

正确答案：C。冶游史

解析：属于个人史的是冶游史，个人史包括社会经理、职业及工作条件、习惯与嗜好、冶游史及性病史（C对）。月经情况属于月经史（A错）。生育情况属于生育史（B错）。家族遗传病史属于家族史（D错）。预防接种史属于既往史（E对）。